槐花除凉血止血外，又能
A. 清热安胎
B. 解毒止痢
C. 散寒止痛
D. 疏肝止痛
E. 清肝泻火

正确答案：E。清肝泻火

解析：本题考查的是槐花的功效。槐花除凉血止血外，又能清肝泻火（E对）。槐花：【功效】凉血止血，清肝泻火。苎麻根：【功效】凉血止血，清热安胎（A错），利尿，解毒。白头翁：【功效】清热解毒，凉血止痢（B错）。艾叶：【功效】温经止血，散寒止痛（C错）。香附：【功效】疏肝理气，调经止痛（D错）。